水硬度指
A. 溶解性固体和悬浮性固体
B. 钙、镁的重碳酸盐
C. 钙、镁的硫酸盐和氧化物
D. 水中不能除去的钙、镁盐类
E. 溶解于水中的钙、镁盐类总和

正确答案：E。溶解于水中的钙、镁盐类总和

解析：本题考查水硬度。硬度指溶于水中钙、镁盐类的总含量（E对ABCD错），以CaCO₃（mg/L）表示。